下述哪项不是低钾血症对骨骼肌的影响
A. 肌无力
B. 肌麻痹
C. 超极化阻滞
D. 静息电位负值减小
E. 兴奋性降低

正确答案：D。静息电位负值减小

解析：低钾血症时，细胞内钾向钾浓度相对较低细胞外液转移，静息电位负值增大（D错，为本题正确答案），细胞处于超极化阻滞状态（C对），细胞兴奋性降低（E对），从而导致肌无力（A对）甚至肌麻痹（B对）。